郁证患者，咽中不适，如有物梗阻，咯之不出，咽之不下，胸中窒闷，舌苔白腻，脉弦滑。其证候是
A. 气滞痰郁
B. 肝气郁结
C. 气郁化火
D. 痰浊上扰
E. 忧郁伤神

正确答案：A。气滞痰郁

解析：肝郁乘脾，脾运不健，生湿聚痰，痰气郁结于胸膈之上，故咽中不适，如有物梗阻，咯之不出，咽之不下；气失舒展，则胸中窒闷；舌苔白腻，脉弦滑，为肝郁挟痰湿之征，故其证候为气滞痰郁证（A对）。肝气郁结证，其证候为精神抑郁，情绪不宁，善太息，胸胁胀痛，痛无定处，脘闷嗳气，腹胀纳呆，或呕吐，大便失常，女子月事不行，苔薄腻，脉弦(B错)。气郁化火证，其证候为性情急躁易怒，胸闷胁胀，嘈杂吞酸，口苦而干，大便秘结，或头痛、目赤、耳鸣，舌质红，苔黄，脉弦数（C错）。郁证没有痰浊上扰证这一分型（D错）。忧郁伤神证，其证候为精神恍惚，心神不宁，悲忧善哭，时时欠伸，舌质淡，脉弦细（E错）。